指利用电离辐射的生物效应治疗肿瘤等疾病的技术的是
A. 放射治疗
B. 核医学
C. 介入放射学
D. X射线影像诊断
E. B超

正确答案：A。放射治疗

解析：放射治疗：是指利用电离辐射的生物效应治疗肿瘤等疾病的技术。掌握“放射诊疗的概念分类及执业条件”知识点。